不断形成的牙本质将髓腔和根管过早地部分或完全的堵塞、闭锁是以下哪种牙齿最常见的表现
A. 牙内陷
B. 畸形中央尖
C. 遗传性乳光牙本质
D. 融合牙
E. 特纳牙

正确答案：C。遗传性乳光牙本质

解析：遗传性乳光牙本质最显著的特点是不断形成的牙本质将髓腔和根管过早地部分或完全的堵塞、闭锁。掌握“遗传性牙本质发育不全”知识点。